安全性评价时，实验动物染毒途径选择的最基本原则是
A. 易于给药
B. 与人接触途径相似
C. 防止污染
D. 不可多途径给药
E. 避免交叉接触

正确答案：B。与人接触途径相似